下列可以区分概率抽样和非概率抽样的选项是
A. 抽样的范围是否已知
B. 每一个对象被抽中的概率是否已知
C. 每一个对象是否已知
D. 每一个对象的概率是否已知
E. 以上均不是

正确答案：B。每一个对象被抽中的概率是否已知

解析：本题考查概率抽样和非概率抽样的区分。每一个对象被抽中的概率是否已知（B对ACDE错）可以区分概率抽样和非概率抽样。